男，42岁，呕吐、腹泻两天，意识模糊、烦躁不安半天急诊入院。查体：BP110/70mmHg，神志恍惚，巩膜中度黄染，颈部可见数枚蜘蛛痣，心肺未见异常，腹软，肝肋下未触及，脾肋下3cm，双上肢散在出血点，Hb90g/L，WBC3.2×10⁹/L，血糖7.0mmol/L，尿糖（+），尿酮（-）尿镜检（-）。对此患者的治疗，下列各项中不正确的是
A. 禁食蛋白质
B. 口服乳果糖
C. 静滴精氨酸
D. 肥皂水灌肠
E. 补充支链氨基酸

正确答案：D。肥皂水灌肠

解析：中年男性患者，巩膜中度黄染、颈部可见数枚蜘蛛痣、双上肢散在出血点（肝功能减退的表现），脾肋下3cm（脾肿大，门静脉高压的表现），提示患者有肝硬化。患者呕吐、腹泻两天（肝硬化引起肝性脑病的诱因），意识模糊、烦躁不安（肝性脑病的表现）半天。综合患者的病史、临床表现、查体检查，可初步诊断为肝性脑病。肝性脑病最主要的发病机制为氨中毒。肥皂水（D错，为本题正确答案）多为碱性溶液，可增加肠道氨的吸收，加重肝性脑病。禁食蛋白质（A对）可以减少氨的产生；口服乳果糖（B对）可减少氨的产生和吸收；静滴精氨酸（C对）理论上有降血氨作用。补充支链氨基酸（E对）可减少假性神经递质的产生，有利于正常的神经传导，缓解病情。